六味地黄汤合黄连阿胶汤适用于甲状腺功能亢进症的哪种证型
A. 心肝阴虚
B. 心肾阴虚
C. 心脾两虚
D. 肝火痰瘀证
E. 肝郁血瘀证

正确答案：B。心肾阴虚

解析：六味地黄汤功能滋阴补心肾，黄连阿胶汤功能滋阴降火安神，两方同用既可滋阴补肾，又可降火安神，适用于心肾两虚，心神不宁者（B对）。